给某患者静脉注射20%葡萄糖50ml，患者尿量显著增加，尿糖定性阳性，分析该患者尿量增多的主要原因：
A. 肾小管对水的通透性降低
B. 肾小球滤过率增大
C. 肾小管溶质浓度增加
D. 肾小管对Na⁺吸收减少
E. 血容量增大

正确答案：C。肾小管溶质浓度增加

解析：该患者由于静脉注射20%葡萄糖50ml，血糖浓度升高，而使超滤液中的葡萄糖量超过近端小管对糖的最大转运率，造成小管液溶质浓度升高（C对），使水和NaCl的重吸收减少，因而尿量增多。